处方中含有抗氧剂的注射剂是
A. 苯妥英钠注射液
B. 维生素C注射液
C. 硫酸阿托品注射液
D. 罗拉匹坦静脉注射乳剂
E. 氟比洛芬酯注射乳剂

正确答案：B。维生素C注射液

解析：本题考查维生素C注射液。维生素C注射液（B对）处方中含有抗氧剂。维生素C注射液处方分析：维生素C-主药；依地酸二钠-金属螯合剂；碳酸氢钠-pH调节剂；亚硫酸氢钠-抗氧剂；注射用水-溶剂。苯妥英钠注射液（A错）处方分析：苯妥英钠-主药；40%丙二醇和10%乙醇-混合溶媒；注射用水-溶剂。硫酸阿托品注射液（C错）处方分析：硫酸阿托品-主药；氯化钠-渗透压调节剂；0. 1mol/L盐酸溶液-pH调节剂；注射用水-溶剂。罗拉匹坦静脉注射乳剂（D错）处方分析：罗拉匹坦-主药；精制大豆油-油相溶剂；卵磷脂-乳化剂；泊洛沙姆-稳定剂；油酸钠-电位调节剂；甘油-渗透压调节剂；注射用水-溶剂。氟比洛芬酯注射乳剂（E错）处方分析：氟比洛芬酯-主药；精制大豆油-油相溶剂；蛋黄卵磷脂-乳化剂；二油酰基磷脂酰丝氨酸-稳定剂；甘氨酸-渗透压调节剂；pH调节剂；注射用水-溶剂。